下列何者不属于滑膜关节的辅助结构
A. 韧带
B. 关节盘
C. 关节唇
D. 关节囊
E. 无

正确答案：D。关节囊

解析：关节又叫做滑膜关节。关节的辅助结构是韧带（A对）、关节盘（B对）、关节唇（C对）、滑膜囊、滑膜襞。关节的基本结构是关节腔、关节面、关节囊（D错，为本题正确答案）。